可引起胃出血和十二指肠溃疡的药品是
A. 人促红素
B. 甲基多巴
C. 利多卡因
D. 阿米卡星
E. 吡罗昔康

正确答案：E。吡罗昔康

解析：本题考查药物不良反应。吡罗昔康（E对）为速效、强效、长效非甾体抗炎药，剂量过大或长期服用可致消化性溃疡、出血。人促红素（A错）可引起纯红细胞再生障碍性贫血。甲基多巴（B错）不良反应较常见的有水钠猪留所致的下肢浮肿、口干。较少见的有药物热或嗜酸性粒细胞增多、肝功能变化（可能属免疫性或过敏性）、精神改变（抑郁或焦虑、梦呓、失眠）、性功能减低、腹泻、乳房增大、恶心、呕吐、晕倒。偶见的有加重心绞痛和心力衰竭。利多卡因（C错）中枢神经系统症状有嗜睡、眩晕，过量注射引起语言障碍、惊厥甚至呼吸抑制；剂量过大可引起窦性过缓、房室传导阻滞等心脏毒性。眼球震颤是利多卡因中毒的早期信号。阿米卡星（D错）具有肾毒性，可引起蛋白尿和急性肾衰竭。